男，43岁。左侧下颌下区反复肿胀3个月，检查：左侧下颌下腺肿大，质硬，伴压痛。下颌下腺侧位片示下颌下腺腺体内结石。行左侧下颌下腺摘除术，术后创口放置负压引流，去除负压引流的指证是
A. 12小时引流量少于20～30ml
B. 12小时引流量少于30～40ml
C. 12小时引流量少于40～50ml
D. 24小时引流量少于20～30ml
E. 24小时引流量少于40～50ml

正确答案：D。24小时引流量少于20～30ml

解析：本题考查外科引流-负压引流。男，43岁。左侧下颌下区反复肿胀3个月，检查：左侧下颌下腺肿大，质硬，伴压痛。下颌下腺侧位片示下颌下腺腺体内结石。行左侧下颌下腺摘除术，术后创口放置负压引流，去除负压引流的指证是24小时引流量少于20～30ml（D对）。引流物的放置时间因手术不同而异。引流物为异物，在达到引流目的后，应尽早拔除。污染创口或为防止积血、积液而放置的引流物，多在24～48小时后去除；脓肿或死腔的引流物应放置至脓液及渗出液完全消除为止；负压引流一般在24小时内引流量少于20～30mL时去除；较小的创口（例如下颌下腺、腮腺手术），24小时内引流量少于15mL时去除。